不属霍乱弧菌生物学特性的是
A. 分古典、EL-Tor两个生物型，均有O、H抗原
B. 无荚膜，芽胞，但有鞭毛
C. 营养要求不高，需氧，耐碱不耐酸
D. 致病物质主要是霍乱肠毒素
E. 革兰阳性菌

正确答案：E。革兰阳性菌